下列关于白血病龈病损的病理变化叙述有误的是
A. 牙龈上皮和结缔组织内充满密集的幼稚白细胞
B. 可见正常的中性粒细胞
C. 可见淋巴细胞和浆细胞的灶性浸润
D. 胶原纤维被幼稚血细胞所代替
E. 毛细血管收缩，可见组织坏死

正确答案：E。毛细血管收缩，可见组织坏死

解析：病理变化为牙龈上皮和结缔组织内充满密集的幼稚白细胞，偶见正常的中性粒细胞、淋巴细胞和浆细胞的灶性浸润。结缔组织高度水肿变性，胶原纤维被幼稚白细胞所代替。毛细血管扩张，血管腔内可见血细胞形成栓塞，并可见组织坏死。掌握“白血病龈病损”知识点。